某女，65岁，糖尿病史8岁，刻下口渴引饮，小便频数，多食善饥，肢体消瘦，体倦乏力，睡眠欠佳，腰膝酸痛；舌淡红，苔白而干，脉细弱。服药后，上述症状减轻。近因劳累，过食辛辣，又见小便频数，尿色黄赤，灼热涩痛，大便干结，尿常规检查：白细胞90个/HP，蛋白质（±），葡萄糖（+）。根据病情变化，宜选用的中成药是
A. 净石灵胶囊
B. 济生肾气丸
C. 知柏地黄丸
D. 分清五淋丸
E. 萆薢分清丸

正确答案：D。分清五淋丸

解析：本题考查的是淋证的辨证论治。糖尿病史8岁，刻下口渴引饮，小便频数，多食善饥，肢体消瘦，体倦乏力，睡眠欠佳，腰膝酸痛；舌淡红，苔白而干，脉细弱。服药后，上述症状减轻。近因劳累，过食辛辣，又见小便频数，尿色黄赤，灼热涩痛，大便干结，尿常规检查：白细胞90个/HP，蛋白质（±），葡萄糖（+）。根据病情变化，宜选用的中成药是分清五淋丸（D对）。淋证是指以小便频数短涩，淋沥刺痛，小腹拘急引痛为主症的疾病。西医学的泌尿系感染、尿路结石、前列腺炎、尿道综合征等病，具有淋证表现特征者，可参考此内容辨证论治。（一）热淋：【症状】小便频数短涩，灼热刺痛，尿色黄赤，少腹拘急胀痛，或有寒热，口苦，呕恶，或腰痛拒按，或大便秘结。舌质红，苔黄腻，脉滑数。【中成药应用】常用中成药有八正胶囊、复肾宁片、分清五淋丸。（二）石淋：【症状】尿中夹有砂石，排尿涩痛，或排尿时突然中断，尿道窘迫疼痛，少腹拘急，往往突发一侧腰腹绞痛难忍，甚则牵及外阴，尿中带血。舌质红，苔薄黄，脉弦或弦数。【中成药应用】常用中成药有复方金钱草颗粒、净石灵胶囊（A错）、五淋化石丸。（三）血淋：【症状】小便热涩刺痛，尿色深红，或夹有血块，疼痛满急加剧，或见心烦。舌尖红，舌苔黄，脉滑数。【中成药应用】常用中成药有肾炎灵胶囊、五淋丸。（四）气淋：【症状】郁怒之后，小便涩滞，淋沥不宣，少腹胀满疼痛。舌苔薄白，脉弦。【中成药应用】常用中成药有为柴胡舒肝丸。（五）膏淋：【症状】小便浑浊，乳白或如米泔水，上有浮油，置之沉淀，或伴有絮状凝块物，或混有血液、血块，尿时热涩疼痛，口干。舌质红，苔黄腻，脉濡数。【中成药应用】常用中成药有为萆薢分清丸（E错）、前列泰片。（六）劳淋：【症状】小便不甚赤涩，溺痛不甚，但淋沥不已，时作时止，遇劳即发，腰膝酸软，神疲乏力，病程缠绵。舌质淡，脉细弱。【中成药应用】常用中成药有为前列回春胶囊、男康片。济生肾气丸（B错）为癃闭肾阳衰惫证的中成药应用。癃闭肾阳衰惫证：【症状】小便不通或点滴不爽，排出无力，面色㿠白，神气怯弱，畏寒肢冷，腰膝冷而酸软无力。舌淡胖，苔薄白，脉沉细或弱。【中成药应用】常用中成药有济生肾气丸、金匮肾气丸。知柏地黄丸（C错）为阴虚发热证的中成药应用。阴虚发热证：【症状】午后潮热，或夜间发热，不欲近衣，手足心热，烦躁，少寐多梦，盗汗，口干咽燥。舌质红，或有裂纹，苔少甚至无苔，脉细数。【中成药应用】常用中成药有知柏地黄丸。